主药剂量太小或浸膏黏性太大而制片困难者应加用
A. 黏合剂
B. 润湿剂
C. 稀释剂
D. 吸收剂
E. 润滑剂

正确答案：C。稀释剂